药品批发企业购进的药品必须符合的基本条件是
A. 必须是合法企业生产或经营的药品
B. 具有法定的质量标准
C. 应有法定的批准文号和生产批号
D. 包装和标识符合有关规定和储运要求
E. 中药材应标明产地

正确答案：A、B、C、D、E。必须是合法企业生产或经营的药品；具有法定的质量标准；应有法定的批准文号和生产批号；包装和标识符合有关规定和储运要求；中药材应标明产地

解析：本题考查药品的采购管理。药品批发企业购进的药品必须符合的基本条件是：必须是合法企业生产或经营的药品（A对）；具有法定的质量标准（B对）；应有法定的批准文号和生产批号（C对）；包装和标识符合有关规定和储运要求（D对）；中药材应标明产地（E对）。